休克时细胞损伤发生最早的部位：
A. 线粒体
B. 溶酶体
C. 细胞膜
D. 细胞核
E. 细胞质

正确答案：C。细胞膜

解析：细胞膜（C对）是休克时细胞最早发生损伤的部位。细胞损伤是休克时各器官功能障碍的共同基础。其损伤首先发生在生物膜（包括细胞膜、线粒体膜、溶酶体膜等），继而细胞器（AB错）发生功能障碍或结构破坏，直至细胞凋亡或坏死（CE错）。